心阴不足，肝气失和而心神烦乱睡眠不安者，治宜选用
A. 天王补心丹
B. 酸枣仁汤
C. 磁朱丸
D. 甘麦大枣汤
E. 朱砂安神丸

正确答案：D。甘麦大枣汤

解析：心阴不足，肝气失和而心神烦乱睡眠不安当予以补心养肝，宁心安神，宜选甘麦大枣汤（D对）--方中小麦为君药，养心阴，益心气，安心神，除烦热。甘草补益心气，和中缓急（肝），为臣药。大枣甘平质润，益气和中，润燥缓急，为佐使药。天王补心丹功用为滋阴养血，补心安神，主治阴虚血少，神志不安证（A错）。酸枣仁汤功用为养血安神，清热除烦，主治肝血不足，虚热内扰之虚烦不眠证（B错）。磁朱丸功用为重镇安神，交通心肾，主治心肾不交证（C错）。朱砂安神丸功用为镇心安神，清热养血，主治心火亢盛，阴血不足证（E错）。